患者，女，26岁，妊娠3个月，因肺炎住院治疗，应禁用的抗菌药物是
A. 阿莫西林
B. 头孢氨苄
C. 青霉素G
D. 左氧氟沙星
E. 阿奇霉素

正确答案：D。左氧氟沙星

解析：本题考查左氧氟沙星。左氧氟沙星（D对）为氟喹诺酮类抗菌药，妊娠及哺乳期妇女应避免服用。青霉素（C错）、阿莫西林（A错）是青霉素类，妊娠期妇女仅在必要时使用。头孢氨苄（B错）可透过胎盘屏障，妊娠及哺乳期妇女须权衡利弊后应用。阿奇霉素（E错）为大环内酯类，妊娠及哺乳期妇女慎用。